全胃肠外营养的指征不包括
A. 短肠综合征
B. 大面积烧伤
C. 急性坏死性胰腺炎
D. 溃疡性结肠炎急性期
E. 肢体外伤性失血

正确答案：E。肢体外伤性失血

解析：全肠外营养指征包括：①高代谢状态，如大面积烧伤（B对）；②胃肠道实际吸收面积不足，如胃肠道皮肤瘘及短肠综合征（A对）；③急性肠道炎性疾病，如溃疡性结肠炎急性期（D对）；④需长期胃肠道禁食，如急性坏死性胰腺炎（C对）；⑤完全性胃肠道梗阻；⑥严重肝、肾功能障碍。而肢体外伤性失血患者的胃肠道功能并未受明显影响（E错，为本题正确答案），可采用肠内营养。